1岁女孩，急起高热，流涎，厌食。查体：可见咽部充血，咽腭弓、悬雍垂、软腭等处可见2～4mm大小的疱疹，心肺（-），最可能的诊断是
A. 疱疹性口炎
B. 鹅口疮
C. 咽-结合膜热
D. 猩红热
E. 疱疹性咽峡炎

正确答案：E。疱疹性咽峡炎